弥散性血管内凝血所引起的贫血主要是属于
A. 失血性贫血
B. 溶血性贫血
C. 缺铁性贫血
D. 再生障碍性贫血
E. 稀释性贫血

正确答案：B。溶血性贫血

解析：微血管病性溶血性贫血（B对ACDE错）是弥散性血管内凝血所引起的贫血。